具有半胱氨酸结构，用于对乙酰氨基酚的解毒的是
A. 乙酰半胱氨酸
B. 右美沙芬
C. 盐酸氨溴索
D. 喷托维林
E. 羧甲司坦

正确答案：A。乙酰半胱氨酸

解析：本题考查对乙酰氨基酚。具有半胱氨酸结构，用于对乙酰氨基酚的解毒的是乙酰半胱氨酸（A对）。乙酰半胱氨酸属于半胱氨酸的类似物，可通过巯基与毒性代谢产物N-乙酰亚胺醌结合使其失活，阻止其与肝细胞的大分子共价结合而解毒。右美沙芬（B错）、盐酸氨溴索（C错）、喷托维林（D错）均不具有半胱氨酸的结构。羧甲司坦（E错）为祛痰药，具有半胱氨酸的结构，但不具有游离的巯基，因此不能与毒性代谢产物结合而解毒。